可与醋酐-浓硫酸反应产生一系列颜色变化的化合物是
A. 强心苷
B. 香豆素
C. 黄酮苷
D. 生物碱
E. 木脂素

正确答案：A。强心苷

解析：本题考查的是强心苷的颜色反应。可与醋酐-浓硫酸反应产生一系列颜色变化的化合物是强心苷（A对）。强心苷的Liebermann-Burchard反应（醋酐-浓硫酸反应）：将样品溶于三氯甲烷，加醋酐-浓硫酸（20∶1），产生红色→紫色→蓝色→绿色→污绿色等颜色变化，最后褪色。也可将样品溶于冰醋酸，加试剂产生同样的反应。香豆素（B错）：（1）异羟肟酸铁反应；（2）三氯化铁反应；（3）Gibb's反应；（4）Emerson反应。黄酮苷（C错）属于黄酮类化合物，黄酮的显色反应：黄酮类化合物的显色反应多与分子中的酚羟基及γ-吡喃酮环有关。1.还原试验：（1）盐酸-镁粉（或锌粉）反应；（2）四氢硼钠（钾）反应；2.金属盐类试剂的络合反应：（1）铝盐；（2）铅盐；（3）锆盐；（4）镁盐；（5）氯化锶；（6）三氯化铁；3.硼酸显色反应；4.碱性试剂显色反应。生物碱（D错）可发生沉淀反应与显色反应。生物碱沉淀反应：大多数生物碱在酸水或稀醇中与某些试剂反应生成难溶于水的络合物或复盐，这一反应称为生物碱沉淀反应，这些试剂称为生物碱沉淀试剂。常用的生物碱沉淀试剂有碘化铋钾试剂、碘化汞钾试剂、碘-碘化钾试剂、硅钨酸试剂、饱和苦味酸试剂、雷氏铵盐试剂等。生物碱显色反应：某些生物碱能与一些试剂反应生成不同颜色的产物，这些试剂称为生物碱显色剂。生物碱显色试剂较多，常用的显色剂有Mandelin试剂（1%钒酸铵的浓硫酸溶液）、Macquis试剂（含少量甲醛的浓硫酸）、Frohde试剂（1%钼酸钠或钼酸铵的浓硫酸溶液）。木脂素（E错）分子中常用的官能团为醇羟基、酚羟基、甲氧基、亚甲二氧基、羧基和内酯环，因此它也具有这些官能团所具有的化学性质。如Labat反应等。